遗忘综合征的三大特征是
A. 谵妄、近记忆障碍、虚构
B. 谵妄、虚构、定向障碍
C. 近记忆障碍、虚构、定向障碍
D. 近记忆障碍、幻觉、定向障碍
E. 幻觉、虚构、定向障碍

正确答案：C。近记忆障碍、虚构、定向障碍

解析：遗忘综合症主要的临床表现为近视记忆障碍、定向力障碍和虚构（此为遗忘综合症的三大特征），且患者无意识障碍，智力相对完好（C对）。